属于长效胰岛素类似物的药物是
A. 低精蛋白锌胰岛素
B. 预混胰岛素类似物（预混门冬胰岛素30）
C. 甘精胰岛素
D. 预混胰岛素（30R）
E. 赖脯胰岛素

正确答案：C。甘精胰岛素

解析：本题考查长效胰岛素类似物。长效胰岛素类似物包括甘精胰岛素（C对）、地特胰岛素、德谷胰岛素。低精蛋白锌胰岛素（A错）属于长效胰岛素。预混胰岛素类似物(预混门冬胰岛素30）（B错）和预混胰岛素(30R）（D错）属于预混胰岛素。赖脯胰岛素（E错）属于速效胰岛素类似物。